心脏紧张源性扩张时
A. 心脏扩张
B. 心肌收缩力增强
C. 两者均有
D. 两者均无
E. 无

正确答案：C。两者均有

解析：心衰代偿期时，心室舒张末期容积（前负荷）增加，心脏扩张，使心肌肌节初长度增大但不超过2.2μm（产生最大收缩力时的肌节长度），心肌收缩力增强，这种心脏扩张伴心肌收缩力增强（AB对，故C为本题正确答案）的情况称为心脏紧张源性扩张。